在我国新疆某地发现当地部分居民有皮肤色素沉着、手掌皮肤过度角化、四肢有周围神经炎等表现。据此认为最有可能与下列哪种化学元素摄入过多有关
A. 氟
B. 铅
C. 镉
D. 砷
E. 铬

正确答案：D。砷

解析：本题考查地方性砷中毒。地方性砷（D对ABCE错）中毒是由于长期自饮用水、室内煤烟、食物等环境介质中摄入过量的砷而引起的一种生物地球化学性疾病。临床上以末梢神经炎、皮肤色素代谢异常、掌跖部皮肤角化、肢端缺血坏疽、皮肤癌变为主要表现，是一种伴有多系统、多脏器受损的慢性全身性疾病。